长期用药可产生耐受性和依赖性的药物是
A. 苯妥英钠
B. 地西泮
C. 卡马西平
D. 阿司匹林
E. 氯丙嗪

正确答案：B。地西泮

解析：本题考查长期用药可产生耐受性和依赖性的药物。长期用药可产生耐受性和依赖性的药物是地西泮（B对）。苯妥英钠（A错）是镇静催眠性抗癫痫药，其不良反应包括：1.局部刺激：本药局部刺激性较大，口服可引起厌食恶心呕吐和腹痛等症状，故宜饭后服用，静脉注射可发生静脉炎；2.牙龈增生；3.神经系统反应：药量过大引起中毒，表现为眼球震颤、复视、眩晕、共济失调等。严重幸可出现语言障碍、精神错乱或昏迷等；4.血液系统反应：由于本品抑制叶酸的吸收并加速其代谢，以及抑制二氢叶酸还原酶活性，长期用药导致叶酸缺乏，可致巨幼红细胞性贫血，宜用甲酰四氢叶酸防治；5.骨骼系统反应：长期应用可致低钙血症、佝偻病样改变和骨软化症，必要时应用维生素D预防；6.过敏反应：可发生皮疹、血小板减少、粒细胞缺乏、冉生障碍性贫血；7.其他。卡马西平（C错）是抗癫痫药，常见的不良反应有：眩晕、视力模糊、恶心呕吐、共济失调、手指震颤、水钠潴留，亦可有皮疹和心血管反应；不需中断治疗，一周左右逐渐消退。阿司匹林（D错）的不良反应包括：1.胃肠道反应：最为常见，口服可直接刺激胃黏膜，引起上腹不适、恶心、呕吐；2.加重出血倾向：阿司匹林能不可逆抑制COX，对血小板合成TXA₂有强大而持久的抑制作用，使血液不易凝固，出血时间延长；3.水杨酸反应：阿司匹林剂量过大（5g/d）时，可出现头痛、眩晕、恶心、呕吐、耳鸣、视、听力减退，总称为水杨酸反应，是使用水杨酸类药物中毒的表现；4.过敏反应：少数患者可出现荨麻疹、血管神经性水肿和过敏性休克；5.瑞夷综合征：在儿童感染病毒性疾病如流感、水痘、麻疹、流行性腮腺炎等使用阿司匹林退热时，偶可引起急性肝脂肪变性-脑病综合征（瑞夷综合征），以肝衰竭合并脑病为突出症状表现，虽少见，但预后恶劣；6.对肾脏的影响：阿司匹林对正常肾功能并无明显影响；但在少数人，特别是老年人，伴有心、肝、肾功能损害的患者，即便用药前肾功能正常，也可引起水肿多尿等肾小管功能受损的症状。氯丙嗪（E错）又名冬眠灵，是吩噻嗪类药物的典型代表，也是应用最广泛的抗精神病药物，其常见不良反应为中枢抑制症状（嗜睡、淡漠、无力等）、M受体拮抗症状（视力模糊、口干、无汗、便秘、眼压升高等）和α受体拮抗症状（鼻塞、血压下降、直立性低血压及反射性心悸等）。